动态数列指标中的环比发展速度属于
A. 率
B. 标准化率
C. 构成比
D. 相对比
E. 绝对数

正确答案：D。相对比

解析：本题考查动态数列指标的相关内容。环比发展速度是某年指标与前一年指标之比，表示某年指标是前一年指标的百分比（D对ABCE错)。变量所有观测值的平均水平，简称为均数。